佝偻病枕秃是由于
A. 多汗，摇头，擦枕
B. 哭闹
C. 结核
D. 血钙降低
E. 颅骨软化

正确答案：A。多汗，摇头，擦枕

解析：佝偻病初期（早期）主要表现为非特异性的神经兴奋性增高症状，如易激惹，烦躁，睡眠不安，夜间惊啼，多汗（与季节无关），枕秃（因烦躁及头部多汗致婴儿常摇头擦枕）。掌握“维生素D缺乏性佝偻病”知识点。